患儿，1岁。急起发热，T39.7℃，咳嗽，流涕，纳差，1天后口腔硬腭、颊部黏膜出现疱疹，2天后出现米粒大小皮疹，以手、足、臀部为主，部分为疱疹，质地较硬，内有浑浊液体，周围绕有红晕，烦躁口渴，小便黄赤，大便秘结，舌苔黄腻。治疗首选方是
A. 麻杏石甘汤
B. 甘露消毒丹
C. 解肌透痧汤
D. 清胃解毒汤
E. 清瘟败毒饮

正确答案：E。清瘟败毒饮

解析：该题考查手足口病的辩证以及方药。手足口病是由感受手足口病时邪(柯萨奇病毒A组)引起的发疹性传染病，临床以手足肌肤、口咽部发生疤疹为特征。湿热蒸盛证为手足口病之重证，多见于年幼儿及感邪较重者，以手足、口部及四肢、臀部疤疹，伴全身明显症状为特征。该患儿，1岁。急起发热，T39.7℃，咳嗽，流涕，纳差，1天后口腔硬腭、颊部黏膜出现疱疹，2天后出现米粒大小皮疹，以手、足、臀部为主，部分为疱疹，质地较硬，内有浑浊液体，周围绕有红晕，烦躁口渴，小便黄赤，大便秘结，舌苔黄腻。可判断为手足口病湿热蒸盛，方药清瘟败毒饮加减（E对）。龙胆泻肝汤治疗痄腮之毒窜睾腹证（A错）。甘露消毒丹治疗手足口病邪犯肺脾（B错）。解肌透痧汤治疗猩红热邪侵肺卫(C错)。清胃解毒汤治疗水痘邪炽气营（D错）。